治疗脑膜白血病首选药物是
A. 长春新碱
B. 环磷酰胺
C. 三尖衫酯碱
D. 6-巯基嘌呤
E. 甲氨蝶呤

正确答案：E。甲氨蝶呤

解析：脑膜白血病即中枢神经系统白血病，多数化疗药物难以通过血脑屏障，常规化疗不能有效缓解中枢神经系统白血病，其治疗首选鞘内注射甲氨喋呤（E对）、阿糖胞苷及颅脊椎照射。长春新碱（P575）（A错）常用于急性淋巴细胞白血病诱导缓解治疗；环磷酰胺（B错）主要用于自身免疫性疾病、恶性淋巴瘤、急、慢性淋巴细胞白血病等的治疗，但其活性产物难以通过血脑屏障；高三尖杉酯碱（P576）（C错）常用于急性粒细胞白血病诱导缓解治疗；6-巯基嘌呤（P575）（D错）主要用于急性淋巴细胞白血病缓解后治疗。